锥体外系副作用发生率高，程度严重的药物是
A. 氯丙嗪
B. 氯氮平
C. 氟哌啶醇
D. 利培酮
E. 珠氯噻醇

正确答案：C。氟哌啶醇